牙齿磨耗程度取决于
A. 食物种类
B. 牙齿硬度
C. 咀嚼习惯
D. 患者年龄
E. 以上均有

正确答案：E。以上均有

解析：牙齿磨耗程度受食物种类、牙齿硬度、咀嚼习惯、患者年龄等均有影响。掌握“磨损”知识点。